某女性患者，邻（牙合）面深龋金属烤瓷冠修复，义齿戴用一段时间后出现过敏性疼痛，原因不可能是
A. 继发龋
B. 牙龈退缩
C. 修复体不密合
D. 粘固剂刺激
E. 粘固剂溶解

正确答案：D。粘固剂刺激

解析：修复体使用一段时间之后出现过敏性疼痛可能的原因：1）继发性龋：多由于牙体预备时龋坏组织未去净，或未做预防性扩展。2）牙龈退缩：修复时牙龈有炎症、水肿或粘固后牙龈萎缩等，均造成牙本质暴露，引起激发性疼痛。3）粘固剂脱落或溶解：修复体不密合、松动；粘固剂或粘固操作不良，粘固剂溶解、脱落、失去封闭作用。D项粘固剂刺激在修复体刚戴入时就容易引起疼痛，而不是使用一段时间后出现。掌握“修复体戴入后的问题及处理”知识点。